大青叶原植物所属的科是
A. 小檗科
B. 蓼科
C. 十字花科
D. 蔷薇科
E. 水龙骨科

正确答案：C。十字花科

解析：本题考查的是大青叶的来源。大青叶原植物所属的科是十字花科（C对）。大青叶：【来源】为十字花科植物菘蓝的干燥叶。来源于小檗科（A错）的中药有淫羊藿等。来源于蓼科（B错）的中药有大黄、何首乌、虎杖、蓼大青叶等。来源于蔷薇科（D错）的中药有地榆、枇杷叶、木瓜、山楂、苦杏仁、桃仁、乌梅、金樱子等。来源于水龙骨科（E错）的中药有骨碎补等。